关于眼用制剂质量要求的说法，错误的是
A. 眼用制剂在启用后最多可使用5周
B. 供外科手术用的眼用制剂不得添加抑菌剂
C. 眼内注射溶液应采用一次性包装
D. 急救用的眼用制剂不得添加抗氧剂
E. 眼用半固体制剂每个容器的装量应不超过5g

正确答案：A。眼用制剂在启用后最多可使用5周

解析：本题考查的是眼用制剂的质量要求。除另有规定外眼用制剂应避光密封贮存，在启用后最多可使用4周（A错，为本题正确答案）。眼用制剂生产与贮藏的有关规定：除另有规定外，滴眼剂每个容器的装量应不超过10ml；洗眼剂每个容器的装量应不超过200ml；眼用半固体制剂每个容器的装盘应不超过5g（E对）；混悬型滴眼剂的沉降物不应结块或聚集，经轻摇应易再分散，并应检查沉降体积比。多剂量眼用制剂一般应加适当抑菌剂，尽量选用安全风险小的抑菌剂、产品标签应标明抑菌剂种类和标示量。除另有规定外，在制剂确定处方时，该处方的抑菌效力应符合《中国药典》抑菌效力检查法的规定。眼内注射溶液、眼内插入剂、供外科手术用和急救用的眼用制剂，均不得添加抑菌剂、抗氧剂或不适当的附加剂（BD对），且应采用一次性使用包装（C对）。眼用半固体制剂基质应过滤灭菌，不溶性药物应预先制成极细粉。眼膏剂、眼用乳膏剂、眼用凝胶剂应均匀、细腻、无刺激性，并易涂布于眼部便于药物分散和吸收。包装容器应无菌、不易破裂，其透明度应不影响可见异物检查。除另有规定外，眼用制剂还应符合相应剂型通则项下各有关规定，如眼用凝胶剂还应符合凝胶剂的规定。除另有规定外，眼用制剂应遮光密封贮存，在启用后最多可使用4周。